下列关于低钾血症临床表现的描述，不正确的是
A. 肌无力为最早的临床表现
B. 均有典型的心电图改变
C. 常与镁缺乏同时存在
D. 严重时可发生多尿
E. 发生碱中毒时尿呈酸性

正确答案：B。均有典型的心电图改变

解析：本题考查低钾血症的临床表现。关于低钾血症临床表现的描述不正确的是均有典型的心电图改变（B错，为本题的正确答案）。低钾血症最早的临床表现是肌无力（A对），先是四肢软弱无力，以后可延及躯干和呼吸肌，一旦呼吸肌受累，可致呼吸困难或窒息。还可有软瘫、腱反射减退或消失。病人有厌食、恶心、呕吐和腹胀、肠蠕动消失等肠麻痹表现。心脏受累主要表现为传导阻滞和节律异常。典型的心电图改变为早期出现T波降低、变平或倒置，随后出现ST段降低、QT间期延长和U波。但并非每个病人都有心电图改变，故不应单凭心电图异常来诊断低钾血症。低钾血症的临床表现有时可以很不明显，特别是当病人伴有严重的细胞外液减少时。这时的临床表现主要是缺水、缺钠所致的症状。但当缺水被纠正之后，由于钾浓度被进一步稀释，此时即会出现低钾血症之症状此外，低钾血症可致代谢性碱中毒，这是由于一方面K+由细胞内移出，与Na+、H+的交换增加（每移出3个K+，即有2个Na+和1个H+移入细胞内），使细胞外液的H+浓度降低；另一方面，远曲肾小管Na、K+交换减少，Na+、H+交换增加，使排H+增多，严重时可发生多尿（D对），这两方而的作用即可使病人发生低钾性碱中毒：此时，尿却呈酸性，即反常性酸性尿（E对）。低钾血症常与镁缺乏同时存在（C对），镁负荷试验具有诊断价值。